在脊髓损伤中，下列哪项表现不可能出现
A. 四肢瘫
B. 双上肢瘫
C. 双下肢瘫
D. 截瘫
E. 单侧上肢瘫痪

正确答案：E。单侧上肢瘫痪

解析：在脊髓损伤中胸腰段损伤使下肢的感觉与运动产生障碍，称为截瘫（D对）；而颈段脊髓损伤后，双上肢也有神经功能障碍，为四肢瘫痪（A对）。单侧上肢瘫痪指单一肢体瘫痪，多见于运动区皮质的病变（E错，为本题正确答案）。